区别尿血与血淋的关键是
A. 尿色的深浅
B. 尿中有无红细胞
C. 尿时痛与不痛
D. 是否伴有全身症状
E. 是否伴有水肿

正确答案：C。尿时痛与不痛

解析：尿血是小便中混有血液或纯血尿的一种病症。随出血量的不同，小便可呈淡红色、鲜红色或酱油色等。主要由于下焦湿热藴结，阴虚火旺，脾肾气虚。血淋系“六淋”之一，属淋证范畴。淋证以尿血或尿中夹血为主要症候者。血淋病位主要在膀胱和肾，且与肝脾亦有关。其主要发病机理为湿热蕴结下焦，导致膀胱气化不利。病久则可由实转虚，而见虚实夹杂证（C对）。尿血和血淋都有小便出血、尿色红赤，甚至溺出纯血等（A错）。尿血和血淋都有小便出血，故尿中均有红细胞（B错）。尿血和血淋都伴有全身症状（D错）。尿血和血淋都不伴有水肿（E错）。